男性，12岁，昨晚进食海鲜，今晨开始畏寒、发热、腹痛，以左下腹甚，腹泻伴明显里急后重，大便8次，初次稀便，继之为黏液脓血便，此病例的诊断为
A. 急性细菌性痢疾轻型（不典型）
B. 急性细菌性痢疾普通型（典型）
C. 急性细菌性痢疾中毒型
D. 慢性迁延性细菌性痢疾
E. 急性胃肠炎

正确答案：B。急性细菌性痢疾普通型（典型）

解析：12岁患儿，患者食海鲜后畏寒、发热、腹痛，以左下腹甚，腹泻伴明显里急后重，排便初为稀便，继之为黏液脓血便，应诊断为急性细菌性痢疾普通型（典型）（B对）。急性细菌性痢疾轻型（不典型）（A错）全身毒血症状轻微，稀便有黏液但无脓血。急性细菌性痢疾中毒型（C错）多见于2～7岁儿童，起病急，全身中毒症状重，可有循环和呼吸衰竭，而肠道症状轻微。慢性迁延性细菌性痢疾（D错）菌痢反复发作或迁延不愈达2个月以上。急性胃肠炎（E错）常表现为恶心呕吐，腹痛腹泻，水样便，少见黏液脓血，一般无里急后重。